疑核发出纤维加入下列脑神经
A. 第V、W、VI对脑神经
B. 第V、Ⅸ、X对脑神经
C. 第V、Ⅶ、Ⅸ脑神经
D. 第Ⅸ、X、X1对脑神经
E. 无

正确答案：D。第Ⅸ、X、X1对脑神经

解析：疑核上部发出的纤维进入舌咽神经，大的中部发出的纤维加入迷走神经，下部发出的纤维构成副神经脑根，进入副神经。因此疑核发出纤维加入第Ⅸ、X、X1对脑神经（D对）。